患者，女，64岁。耳中如蝉鸣4年，时作时止，劳累则加剧，按之鸣声减弱。治疗应首选
A. 太阳、听会、角孙
B. 丘墟、足窍阴、外关
C. 太阳、听会、合谷
D. 听会、侠溪、中渚
E. 太溪、照海、听宫

正确答案：E。太溪、照海、听宫

解析：该患者以耳中如蝉鸣4年为主症，故诊断为耳鸣，时作时止，劳累则加剧，按之鸣声减弱故为虚证。选穴以足少阴经穴为主。选耳门、听宫、太溪、照海穴以益肾养窍（E对）。实证以足少阳、手少阳经穴为主（ABCD错）。